某调查项目针对目标人群开展的生活质量评价属于
A. 社会诊断
B. 教育诊断
C. 流行病学诊断
D. 行为与环境诊断
E. 管理与政策诊断

正确答案：A。社会诊断